关于道德权利，下述提法中正确的是
A. 道德权利都是法律权利
B. 道德权利是依法行使的权力和应享受的利益
C. 道德权利是法律权利的后盾
D. 道德权利与道德义务是对应的
E. 道德权利是尽道德义务的前提

正确答案：D。道德权利与道德义务是对应的